心室肌细胞动作电位各时期的跨膜电位变化不包括
A. 0期去极
B. 1期复极
C. 2期平台期
D. 3期复极
E. 4期自动去极

正确答案：E。4期自动去极